在下列工业生产中，何者不宜采用湿式作业
A. 采煤
B. 开凿隧道
C. 水泥生产
D. 矿山生产
E. 以上全部

正确答案：C。水泥生产

解析：本题考查湿式作业。湿式作业是一种既经济又简单实用的防、降尘措施，如采用湿式碾磨石英、耐火原料，开凿隧道（B错）、矿山（D错）湿式凿岩，井下运输喷雾洒水，煤层高压注水（A错）等，可在很大程度上防止粉尘飞扬，降低作业场所粉尘浓度。如果在水泥生产（C对）时使用湿式作业会使生产出来的水泥结块而无法使用（D错）。